某医师随机抽样调查了500例本地产妇及400例外来人口中产妇的如下指标：婴儿性别、产妇年龄年人均收入（元）、产前检查次数、是否有妊娠高血压综合征、有无子痫、基础血压（mmHg）等。要分析外来人口中婴儿性别与是否有妊娠高血压综合征的关系，应选用的统计分析方法是
A. 进行标准化
B. 成组t检验
C. 四格表X²检验
D. 方差分析
E. 配对t检验

正确答案：C。四格表X²检验